男，72岁。尿频、排尿困难、尿不成线半年余。曾发生急性尿潴留4次。经检查确诊为良性前列腺增生。肺、肝、肾功能检查未见异常。若患者选择保守治疗，常用的治疗方案是
A. 间歇导尿
B. 抗炎治疗
C. ɑ受体阻滞剂
D. 激光治疗
E. 以上均不对

正确答案：C。ɑ受体阻滞剂

解析：老年男性患者，确诊良性前列腺增生，有明显梗阻、反复尿潴留，肺肝肾功能良好，若选择保守治疗，可选用ɑ受体阻滞剂（C对）、5α还原酶抑制剂和植物类药等。间歇导尿（A错）易导致泌尿系感染。抗炎治疗（B错）为合并有泌尿系感染的对症治疗。激光治疗（D错）虽可用于治疗前列腺增生，但费用昂贵，一般用于不能耐受手术的病人。